心身疾病的界定条件是
A. 在发病的原因中心理社会因素是重要的因素
B. 具有由心理因素引起的躯体症状
C. 具有明显的器质性病理改变或病理生理变化
D. 不是神经症和精神病
E. 以上都是

正确答案：E。以上都是